关于谷类中营养素分布特点，描述正确的是
A. 维生素E在糊粉层中含量丰富
B. 谷皮中含有丰富的蛋白质
C. 淀粉主要集中在胚乳中
D. 脂肪只存在于胚芽中
E. 胚乳中纤维素含量较多

正确答案：C。淀粉主要集中在胚乳中

解析：本题考查谷类中营养素的分布特点。谷粒由谷皮、糊粉层、胚乳和胚四个部分构成。谷皮为谷粒外面的多层被膜，主要由纤维素（E错）、半纤维素等组成，含较高的矿物质和脂肪（B错）。糊粉层介于谷皮与胚乳之间，含丰富蛋白质、脂肪（D错）、矿物质和B族维生素。胚乳是谷类的主要部分，含大量淀粉（C对）和一定量蛋白质，还含有少量的脂肪、矿物质和维生素。胚芽富含脂肪、蛋白质、矿物质、B族维生素和维生素E（A错）。